患者，男，50岁。患消渴病5年，症见腰膝酸软、头晕耳鸣、骨蒸潮热、盗汗遗精、消渴。中医辨为肾阴虚证，处以六味地黄汤，药用。熟地黄24g、酒黄肉12g、山药12g，泽泻9g、牡丹皮9g、茯苓9g。7剂，每日一剂，水煎服。根据患者的病情，处方中山药的炮制方法是
A. 麸炒
B. 清炒
C. 土炒
D. 切制
E. 蜜炙

正确答案：D。切制

解析：本题考查的是山药的炮制方法及作用。患消渴病5年，症见腰膝酸软、头晕耳鸣、骨蒸潮热、盗汗遗精、消渴。中医辨为肾阴虚证，处以六味地黄汤，药用。熟地黄24g、酒黄肉12g、山药12g，泽泻9g、牡丹皮9g、茯苓9g。7剂，每日一剂，水煎服。根据患者的病情，处方中山药的炮制方法是切制（D对）。山药：【炮制作用】山药味甘，性平，归脾、胃、肾经。具有补脾益胃，生津益肺，补肾涩精的功能。①山药以补肾生精，益肺阴为主。用于肾虚遗精、尿频，肺虚喘咳，阴虚消渴。②土炒山药（C错）以补脾止泻为主，用于脾虚久泻。③麸炒山药（A错）以补脾健胃为主。用于脾虚食少，泄泻便溏，白带过多。清炒（B错）山药与蜜炙（E错）山药，2022年考试指南未明确说明。